药学技术人员在取得执业药师资格证书后，欲从事执业药师执业活动。关于其应履行的程序和要求的说法，正确的是
A. 不需办理注明申请手续即可直接执业
B. 经过一年的继续教育才能申请执业
C. 通过六个月执业实习并考核合格后才能申请执业
D. 申请注册并取得执业药师注册证之后方可执业

正确答案：D。申请注册并取得执业药师注册证之后方可执业

解析：本题考查的是执业药师注册管理。药学技术人员在取得执业药师资格证书后，欲从事执业药师执业活动。关于其应履行的程序和要求的说法，正确的是申请注册并取得执业药师注册证之后方可执业（D对）。执业药师注册要求：我国执业药师实行注册制度，国家药品监督管理局负责执业药师注册的政策制定和组织实施，指导全国执业药师注册管理工作。各省、自治区、直辖市药品监督管理部门负责本行政区域内的执业药师注册管理工作。取得执业药师职业资格的药学专业技术人员，经执业单位考核同意，通过全国执业药师注册管理信息系统向所在地注册管理机构申请注册。经批准注册者，由执业药师注册管理机构核发国家药监局统一样式的《执业药师注册证》，方可从事相应的执业活动（ABC错）。未经注册者，不得以执业药师身份执业。执业药师注册有效期为五年。需要延续的，应当在有效期届满三十日前，向所在地注册管理机构提出延续注册申请。